男，56岁。反复上腹胀痛1年，进食后呕吐1个月，呕吐物含有宿食。査体：贫血貌，消瘦，上腹可见胃型，可闻及振水音。最有价值的辅助检査是
A. B超
B. 腹部CT
C. 胃镜
D. 腹部X线平片
E. 上消化道钡餐

正确答案：C。胃镜

解析：中年男性患者，上腹痛1年，进食后呕吐1个月，呕吐物含有宿食，查体上腹可见胃型，可闻及振水音（提示幽门梗阻），结合患者病史和体查，应考虑为消化性溃疡合并幽门梗阻。为明确诊断，最有价值的辅助检查是胃镜（C对）。胃镜可以直接观察到狭窄、不规则的幽门，同时还可进行活组织病理检查以排除肿瘤。B超（A错）、腹部CT（B错）、腹部X线平片（D错）对腹部空腔脏器的显示效果不佳，一般不用于幽门梗阻的诊断。幽门梗阻时由于钡剂很难通过且很难经胃管吸出，因此一般不选择上消化道钡餐造影（E错）。